如用一手指插入心包斜窦，紧位于手指前方的结构为
A. 右心房
B. 右心室
C. 左心室
D. 左心房
E. 主动脉

正确答案：D。左心房

解析：心包斜窦为位于左心房后壁，如用一手指插入心包斜窦，紧位于手指前方的结构为左心房（D对）。